血液循环停止后血液对血管壁的侧压称为
A. 收缩压
B. 舒张压
C. 脉压
D. 平均动脉压
E. 循环系统平均充盈压

正确答案：E。循环系统平均充盈压